心阳不潜，营阴不守所致的盗汗证宜选用
A. 当归六黄丸
B. 大补阴丸
C. 牡蛎散
D. 生脉散
E. 玉屏风散

正确答案：C。牡蛎散

解析：心阳不潜，营阴不守所致的盗汗，当治以敛阴止汗，方选牡蛎散（C对）。方中煅牡蛎咸涩微寒，敛阴潜阳，固涩止汗，为君药。生黄芪味甘微温，益气实卫，固表止汗，为臣药。君臣相配，是为益气固表、敛阴潜阳的常用组合。麻黄根甘平，功专收敛止汗，为佐药。小麦甘凉，专入心经，养气阴，退虚热，为佐使药。当归六黄汤功用为主治（A错）。大补阴丸功用为主治（B错）。生脉散方为益气养阴生脉之代表方，以气短，乏力，自汗，咽干，舌干红，脉虚数为辨证要点（D错）。玉屏风散功用为益气固表止汗，主治表虚自汗（E错）。